高气湿是指环境相对湿度大于
A. 0.5
B. 0.6
C. 0.7
D. 0.8
E. 0.9

正确答案：D。0.8

解析：本题考查气湿的分类。生产环境中的气湿以相对湿度表示。相对湿度80%（D对ABCD错）以上为高气湿，低于30%为低气湿。